药物组成中含有白术，茯苓的方剂是
A. 五苓散
B. 补中益气汤
C. 小建中汤
D. 真人养脏汤
E. 猪苓汤

正确答案：A。五苓散

解析：本题考查方剂的药物组成。五苓散由猪苓、桂枝、泽泻、白术、茯苓组成（A对）。补中益气汤由黄芪、白术、陈皮、升麻、柴胡、人参、甘草、当归组成（B错）。小建中汤由饴糖、桂枝、芍药、炙甘草、大枣、生姜组成（C错）。真人养脏汤由人参、当归、白术、肉豆蔻、肉桂、甘草、白芍药、木香、诃子、罂粟壳组成（D错）。猪苓汤由猪苓、茯苓、泽泻、阿胶、滑石组成（E错）。